类风湿性关节炎的发病基础是
A. 细菌感染
B. 免疫反应
C. 病毒感染
D. 寒冷
E. 潮湿

正确答案：B。免疫反应

解析：类风湿性关节炎的病因及发病机制：1.免疫因素，免疫紊乱被认为是RA主要的发病机制，以活化的CD⁺4T细胞和MHC-Ⅱ型阳性的抗原递呈细胞浸润关节滑膜为特点。关节滑膜组织的某些特殊成分或体内产生的内源性物质也可能作为自身抗原被APC呈递给活化CD⁺4T细胞。特异性免疫应答，T细胞、巨噬细胞活化产生大量细胞因子如TNF-α、IL-1、IL-6、IL-8等，促进炎症反应，破坏关节软骨和骨，造成关节畸形。IL-1是引起RA全身症状如低热、乏力、急性期蛋白合成增多的主要细胞因子，是造成C反应蛋白和血沉升高的主要因素（B对）。2.感染因素，尚未被证实有导致本病的直接感染因子，但目前认为一些感染因素（病毒、支原体、细菌等）可能通过分子模拟等机制导致自身免疫反应（AC错）。3.遗传因素。在中医中，本病发病多因先天禀赋不足，或劳逸不当，正气亏损，风、寒、湿、热等外邪乘虚而入（DE错）。